腹股沟浅淋巴结
A. 位于大腿阔筋膜深面
B. 沿股静脉排列
C. 收纳下肢所有淋巴
D. 其输出管注入腹股沟深淋巴结
E. 收纳腹前壁深淋巴

正确答案：D。其输出管注入腹股沟深淋巴结

解析：腹股沟浅淋巴结位于腹股沟韧带下方（A错），上群与腹股沟韧带平行排列，收纳腹前外侧壁下部，即腹前壁浅淋巴等淋巴结（E错），下群沿大隐静脉分布（B错），收纳除了足外侧缘和小腿后外侧部的浅淋巴（C错），输出管注入腹股沟深淋巴结（D对）或髂外淋巴结。